根据《总局办公厅关于加强互联网药品医疗器械交易监管工作的通知》，按照“线上线下一致”原则，建立完善互联网药品交易服务企业监管制度，规范交易行为。下列互联网药品交易行为中，符合法律法规要求的有
A. 戊药品生产企业通过自建网站，将非处方药销售给个人消费者
B. 丁药品零售连锁企业通过自建网站向患者销售了乙类非处方药培菲康（冷藏类生物制品）由企业执业药师持内装蓄冷剂的保温箱送至消费者
C. 乙药品生产企业自建网站将处方药销售给丙药品零售企业
D. 甲药品零售连锁企业制定了网络药品销售管理制度，规定只在网上销售非处方药，对其中的含麻黄碱类复方制剂要求个人消费者上传身份证信息，且每次购买不得超过2盒

正确答案：B、C。丁药品零售连锁企业通过自建网站向患者销售了乙类非处方药培菲康（冷藏类生物制品）由企业执业药师持内装蓄冷剂的保温箱送至消费者；乙药品生产企业自建网站将处方药销售给丙药品零售企业

解析：本题考查的是网络药品经营管理。根据《总局办公厅关于加强互联网药品医疗器械交易监管工作的通知》，按照“线上线下一致”原则，建立完善互联网药品交易服务企业监管制度，规范交易行为。下列互联网药品交易行为中，符合法律法规要求的有丁药品零售连锁企业通过自建网站向患者销售了乙类非处方药培菲康（冷藏类生物制品）由企业执业药师持内装蓄冷剂的保温箱送至消费者（B对）；乙药品生产企业自建网站将处方药销售给丙药品零售企业（C对）。网络药品交易服务的类型：1.企业对企业模式，Business to Business （B-to-B）：药品上市许可持有人、药品批发企业通过自建网站，从网上采购药品或将药品销售给其他药品上市许可持有人、药品生产企业、药品经营企业和药品使用单位，以及药品零售企业、医疗机构从网上向药品上市许可持有人、药品批发企业采购药品的网络药品交易服务模式。药品上市许可持有人、药品批发企业通过网络销售药品的，应当按规定向所在地省级药品监督管理部门备案。2.企业对个人消费者模式，Business-to-Customer （B-to-C）：药品零售企业通过自建网站，向个人消费者销售药品，并按照药品GSP要求配送至个人消费者的网络药品交易服务模式。药品零售企业通过网络销售药品的，应当按规定向所在地市县级药品监督管理部门备案。3.药品网络交易第三方平台模式：药品网络交易第三方平台提供者通过网络系统，为在药品网络交易活动中的购销双方提供网络药品交易服务的模式。4.线上与线下联动模式，Online to Offline （O-to-O）：（1）“网订店取”，个人消费者通过网络下单购买药品，赴就近的药品零售企业经营场所获取药品和相关药学服务。（2）“网订店送”，个人消费者通过网络下单购买药品，由药品零售企业的执业药师或其他药学技术人员按照药品GSP配送药品的要求，将购买的药品送递至个人消费者，并当面向其提供相关药学服务。国家鼓励药品零售企业向个人消费者提供“网订店取”“网订店送”模式的网络药品交易服务。网络销售药品的条件：1.药品网络销售者应当是取得药品上市许可持有人、药品经营企业。其他企业、机构及个人不得从事药品网络销售，法律法规另有规定的除外（A错）。药品网络销售范围不得超出药品持有、药品经营许可范围。药品网络销售者为药品上市许可持有人、药品批发企业的，不得向个人消费者销售药品。药品网络销售者为药品零售企业的，不得通过网络销售含麻黄碱类复方制剂等国家有专门管理要求的药品（D错）。2.药品网络销售者除符合国家药品监督管理以及网络交易管理的法律、法规、规章要求外，还应当具备下列条件：①有企业管理实际需要的应用软件、网络安全措施和相关数据库，能够满足业务开展要求；②有药品网络销售安全管理制度，可实现药品销售全程可追溯、可核查；③有保障药品质量与安全的配送管理制度；④有投诉举报处理、消费者权益保护制度；⑤有网上药品不良反应（事件）监测报告制度；⑥依法持有《互联网药品信息服务资格证书》。销售对象为个人消费者的，还应当建立在线药学服务制度，配备执业药师，指导合理用药。3.药品网络销售者应当在网站首页或者经营活动的主页面醒目位置清晰展示相关资质证明文件、备案凭证和企业联系方式，并将展示的证书信息链接至国家药品监督管理局网站对应的数据查询页面。证书发生变更的，应当及时更新网站展示信息。销售对象为个人消费者的，还应当展示《执业药师注册证》。